能有效控制绿脓杆菌感染的药物是
A. 四环素
B. 利巴韦林
C. 妥布霉素
D. 氟康唑
E. 林可霉素

正确答案：C。妥布霉素

解析：铜绿假单胞菌原名绿脓杆菌，妥布霉素用于治疗绿脓杆菌所致的各种感染（C对）。四环素类药物（包括四环素）首选治疗立克次体感染（A错）、支原体感染、衣原体感染以及某些螺旋体感染。利巴韦林主要用于病毒感染（B错）。氟康唑主要用于念珠菌、隐球菌等真菌感染（D错）。林可霉素可用于葡萄球菌属引起的轻中度感染（E错）。